女性甾体激素进行的高效避孕方法是
A. 使用避孕工具
B. 体外受精
C. 试管婴儿
D. 口服促排卵激素
E. 使用激素类避孕药

正确答案：E。使用激素类避孕药

解析：激素避孕是指女性甾体激素避孕，是一种高效的避孕方法。掌握“激素避孕”知识点。